艾滋病（AIDS）的主要传播途径之一是
A. 性接触传播
B. 眼结膜接触传播
C. 呼吸道传播
D. 虫媒传播
E. 消化道传播

正确答案：A。性接触传播